下列关于“实”的叙述，错误的是
A. 外感邪盛
B. 肌肤经络闭塞
C. 气机升降失调
D. 脏腑功能亢进
E. 气血壅滞瘀结

正确答案：C。气机升降失调

解析：本题考查实证的病理表现，属于理解记忆内容。实证常见于外感六淫（A对）和疠气致病的初期和中期，或由于湿、痰、水饮、食积、气滞、瘀血等引起的内伤病证。肌肤经络闭塞、脏腑功能亢进、气血壅滞瘀结都属于机体正气的抗病能力未衰并积极与邪抗争的表现（BDE对）。气机升降失调不是以邪气亢盛为矛盾主要方面的一种病理状态，而是气的运动出现异常变化，升降出入之间失去协调平衡的病理状态，由于气的运动形式是多种多样的，所以气机失调也有多种表现，可以有气机不畅，也可以出现气脱的表现，所以不能笼统的说气机升降失调是实证（C错，为本题正确答案）。